治疗心房颤动抗心力衰竭药是
A. 呋塞米
B. 地高辛
C. 依那普利
D. 米力农
E. 多巴酚丁胺

正确答案：B。地高辛

解析：本题考查地高辛。地高辛（B对）适用于心力衰竭伴有快速心事率的心房颤动患者。呋塞米（A错）为高效的利尿剂，用于高血压、充血性心力衰竭。依那普利（C错）是血管紧张素转换酶抑制剂，适用于原发性高血压、心力衰竭。米力农（D错）是磷酸二酯酶Ⅲ抑制剂，多巴酚丁胺（E错）为非苷类正性肌力药。